现况调查常可遇到“无应答”，由无应答所引起的偏倚为
A. 选择偏倚
B. 回忆偏倚
C. 测量偏倚
D. 调查人员偏倚
E. 报告偏倚

正确答案：A。选择偏倚

解析：本题考查无应答偏倚的概念。无应答偏倚是指调查对象因不愿合作或其他种种原因不能或不愿意参加调查从而降低了应答率，若应答率低于70%就难以用调查结果来估计整个研究总体的状况。无应答偏倚属于选择偏倚（A对BCDE错）。